女，44岁，经诊断为慢性牙周炎并经基础治疗4周后，左上6牙周袋探诊深度仍然为6mm，且探诊易出血，龈退缩1mm，附着龈宽度为4mm，X-ray示根分叉区透射，则该患者最适宜做
A. 袋内壁刮治术
B. 牙龈成形术
C. 袋壁切除术
D. 截根术
E. 引导组织再生术

正确答案：C。袋壁切除术

解析：本题考查Ⅳ度根分叉病变的治疗。Ⅳ度根分叉病变的根间骨隔完全破坏，且牙龈退缩而使病变的根分叉区直接暴露于口腔，患牙根分叉区X线片显示透射影，牙龈退缩1mm，据此可判断为Ⅳ度根分叉病变。袋壁切除术（C对）适用于Ⅲ度或Ⅳ度根分叉病变的颊侧深牙周袋有足够宽附着龈的病例，若附着龈较窄，则应行翻瓣术，在刮净根面及修整骨缺损后，将龈瓣根向复位并缝合与牙槽嵴水平。袋内壁刮治术（A错）是以最小的创伤，最大的组织保留，用手术刮治并彻底清除袋壁病变组织，但保留牙龈外壁的方法，适用于范围比较局限的三壁骨下袋和经过洁治、刮治依然存在的骨上袋。牙龈成形术（B错）的目的较单一，主要是为了修整牙龈形态，重建牙龈正常的生理外形，常与牙龈切除术合并使用。截根术（D错）是指将患根分叉病变的多根牙中破坏最严重的一个或两个牙根截除，消灭分叉区病变，同时保留牙冠和其余的牙根，继续行使功能，适用于多根牙的某一个或两个根的牙周组织破坏严重，且有重度根分叉病变，而其余牙根病情较轻，牙齿松动不明显者。引导组织再生术（E对）是在牙周手术中利用膜性材料作为屏障，引导具有形成新附着能力的牙周膜细胞优先占领根面，从而在原已暴露于牙周袋内的根面上形成新的牙骨质，并有牙周膜纤维埋入，形成牙周组织的再生，适用于有足够牙龈高度的Ⅱ度根分叉病变，尤以下颌牙的Ⅱ度根分叉病变效果好。